输卵管妊娠最常见的病因是
A. 输卵管发育或功能异常
B. 慢性输卵管炎
C. 输卵管复通术后
D. 子宫内膜异位症
E. 宫内放置节育器后

正确答案：B。慢性输卵管炎

解析：慢性输卵管炎由于炎症造成官腔狭窄、管壁薄、内膜的蜕膜反应差，限制了孕卵发育，阻碍受精卵在输卵管内的正常运行，所以在输卵管最容易引起妊娠（B对）。输卵管发育或功能异常（A错）、输卵管手术（C错）、宫内节育器（E错）均能导致异位妊娠，但不是输卵管妊娠最常见的病因。子宫内膜异位症（D错）是是引起盆腔疼痛与不孕的主要原因之一，非输卵管妊娠的原因。